患者反复呕吐隔餐食物。查体：消瘦，上腹部膨胀，并见胃型。应首先考虑的是
A. 肝炎
B. 肝硬化
C. 胃炎
D. 幽门梗阻
E. 胆囊炎

正确答案：D。幽门梗阻

解析：患者反复呕吐隔餐食物（胃排空障碍）。查体：消瘦，上腹部膨胀，并见胃型。该患者可诊断为幽门梗阻（D对）。肝炎（A错）、肝硬化（B错）、胆囊炎（E错）可有上腹部膨隆，但一般无反复呕吐隔餐食物。胃炎（C错）一般无腹部膨隆。